医学心理学研究任务不包括
A. 研究心理因素对人体健康的影响及其机制
B. 研究个性的形成和发展
C. 研究自我调节对防病、治病和康复的作用
D. 研究疾病过程中的心理反应
E. 研究心理因素在疾病发展过程中的作用

正确答案：B。研究个性的形成和发展